引起Graves病基本的原因是
A. 长期碘摄入不足
B. 长期碘摄入过多
C. 各种因素致下丘脑分泌TRH过多
D. 各种原因致垂体分泌TSH过多
E. 遗传易感性和自身免疫功能异常

正确答案：E。遗传易感性和自身免疫功能异常

解析：Graves病与组织相容性复合体基因相关，具有遗传易感性；Graves病是一种自身免疫性疾病，血清中存在TSH受体抗体，包括TSH受体刺激性抗体（TSAb）和TSH受体刺激阻断性抗体（TSBAb）。TSAb可结合并激活TSH受体，导致甲状腺细胞增生和甲状腺激素合成、分泌增加，引起甲亢。所以引起Graves病基本的原因是遗传易感性和自身免疫功能异常（E对）。长期碘摄入不足（A错）是单纯性地方性甲状腺肿的基本病因。长期碘摄入过多（B错）是散发性甲状腺肿的原因之一。Graves病为自身免疫因素导致的TSH受体刺激性抗体增多并作用于TSH受体引起的血甲状腺激素增高，其血TRH、TSH常降低（CD错）。